一种有毒物质，不具有致畸等特殊毒性，其动物最大无作用剂量为1g/kg体重，该有毒物质通过食物的摄入量占总暴露量的80%，水占20%。有两种食物中含有该有毒物质，一种物质每天摄入250g，另一种摄入150g，那么这两种食物中该有毒物质的平均最大容许量为
A. 32mg/kg
B. 240mg/kg
C. 1200mg/kg
D. 1920mg/kg
E. 3200mg/kg

正确答案：C。1200mg/kg